《中华人民共和国执业医师法》规定医师的神圣职责是
A. 受社会尊重，受法律保护
B. 加强医师管理注册
C. 防病治病，救死扶伤
D. 加强医师队伍建设，保护人民健康
E. 检验评价专业知识与能力

正确答案：C。防病治病，救死扶伤

解析：《中华人民共和国执业医师法》规定医师的神圣职责是防病治病，救死扶伤。医师应当具备良好的职业道德和医疗执业水平，发扬人道主义精神，履行防病治病、救死扶伤、保护入民健康的神圣职责（C对）。